亚硫酸氢钠可作为
A. 乳化剂
B. 助悬剂
C. 两者均是
D. 两者均不是

正确答案：D。两者均不是

解析：本题考查注射剂常用的附加剂。亚硫酸氢钠为白色结晶性粉末，具有二氧化硫臭味，有还原性。水溶液呈酸性，主要用于酸性药物的抗氧剂（D对）。注射剂中常用的乳化剂有泊洛沙姆188、吐温80、聚维酮等。注射剂中常用的助悬剂有羧甲基纤维素、明胶、果胶等。